治疗窦性心动过速的药
A. 阿奇霉素
B. 异烟肼
C. 阿司匹林
D. 环丙沙星
E. 普萘洛尔

正确答案：E。普萘洛尔

解析：本题考查β受体阻断药。治疗窦性心动过速的药为普萘洛尔（E对）。阿奇霉素（A错）主要用于呼吸道、皮肤、软组织及泌尿生殖器的感染。异烟肼（B错）常为结核病的首选药。阿司匹林（C错）常与其他解热镇痛药制成复方制剂。解热镇痛每次0.3～0.6g，每日3次，饭后服用。用于治疗风湿、类风湿关节炎每日3～5g，分4次服用。预防血栓形成每次20～50mg，每日1次。环丙沙星（D错）适用于敏感菌所引起的呼吸道、泌尿道、消化道、胆道、皮肤与软组织感染、败血症、腹腔及耳鼻喉科感染等的治疗。